坏血病患者应补充的维生素是
A. 维生素A
B. 维生素B
C. 维生素C
D. 维生素D
E. 泛酸

正确答案：C。维生素C

解析：维生素C是胶原蛋白形成所必需的物质，有助于保持细胞间质物质的完整，当严重缺乏时可引起维生素C缺乏病，又称坏血病（C对）。